单室模型药物恒速静脉滴注给药，达稳态药物浓度90%需要的滴注给药时间是
A. 1.12个半衰期
B. 2.24个半衰期
C. 3.32个半衰期
D. 4.46个半衰期
E. 6.64个半衰期

正确答案：C。3.32个半衰期

解析：本题考查单室模型静脉滴注给药。单室模型药物恒速静脉滴注给药，达稳态药物浓度90%需要的滴注给药时间是3.32个半衰期（C对）；静脉滴注给药达到稳态血药浓度的百分数与半衰期之间的关系式为：n=-3.32lg（1-fss），fss为达坪分数，n表示半衰期个数，代入90%得n为3.32。